患儿，4岁。壮热恶风，少汗，头痛，鼻塞流脓涕，咽红肿，口渴，小便短赤，大便秘结，舌苔糙而黄垢。治疗以银翘散为主方，还应加
A. 生石膏、知母
B. 大黄、玄明粉
C. 槟榔、莱菔子
D. 枳实、厚朴
E. 神曲、山楂

正确答案：B。大黄、玄明粉

解析：患儿恶风，鼻塞流涕，咽红肿当属感冒，证属风热感冒。风热之邪，首先犯肺，邪在卫表，卫气不畅，则致壮热恶风、少汗，风热之邪上扰，则头痛，热邪客于肺卫，肺气失宣，则致鼻塞、流涕、喷嚏、咳嗽，咽喉为肺胃之门户，风热上乘咽喉，则致咽喉肿痛，表邪入阳明经化热，表里同病，则见小便短赤，大便秘结，舌苔糙而黄垢，银翘散可辛凉解表，大黄可通腑泄热，解阳明气分之热，玄明粉为芒硝经风化干燥制得，与大黄有相似功效（B对）。石膏、知母善解气分大热所致大汗、大热、大渴、脉洪大等病症，无通腑之效（A错）。槟榔主治虫积、食积气滞等症，莱菔子善于消食除胀，降气化痰（C错）。枳实、厚朴为行气药，善于治疗食积气滞，腹胀便秘等症（D错）。神曲、山楂善于治疗积食之症（E错）。